患者呕吐清水痰涎，脘闷不食，头晕心悸，舌苔白腻，脉滑。其证候是
A. 饮食停滞
B. 痰饮内阻
C. 气滞痰阻
D. 食积痰阻
E. 气滞食积

正确答案：B。痰饮内阻

解析：本病例以呕吐清水痰涎为主症，故诊断为呕吐；脾不健运，痰饮内停，胃气不降，则呕吐清水痰涎，脘闷不食；水饮上犯，清阳之气不展，故头晕；水气凌心，则心悸；舌苔白腻，脉滑，均为痰饮内停之征，故其证候为痰饮内阻证（B对）。饮食停滞证，其证候为“呕吐酸腐，脘腹胀满，嗳气厌食，大便或溏或结，舌苔厚腻，脉滑实”，本病例没有“呕吐酸腐，脘腹胀满”等饮食内停的症状(ADE错）。呕吐没有气滞痰阻证（C错）。